洪脉、实脉的共同特征是
A. 来盛去衰
B. 如波涛汹涌
C. 部位表浅
D. 脉体宽大
E. 端直以长

正确答案：D。脉体宽大

解析：洪脉是脉体宽大而浮，充实有力，来盛去衰，状若波涛汹涌。实脉是三部脉举按均充实有力，其势来去皆盛，应指愊愊。亦为有力脉象的总称。实脉的含义有二，一是有力之脉，其脉象特点是脉搏搏动力量强，寸、关、尺三部，浮、中、沉三候均有力量，脉管宽大，所以脉体宽大是洪脉、实脉的共同特征(D对)。来盛去衰（A错）、如波涛汹涌 （B错）、部位表浅（C错）是洪脉的特征。端直以长（E错）是牢脉的特征。